住宅室温标准一般是指气湿、气流、热辐射在正常范围时，居室中央距地板多高处的气温
A. 0.5m
B. 1.0m
C. 1.5m
D. 2.0m
E. 2.5m

正确答案：C。1.5m

解析：本题考查住宅室温标准。住宅室温标准一般是指气湿、气流、热辐射在正常范围时，居室中央距地板1.5m（C对ABDE错）高处的气温。